最容易发生变异的呼吸道病毒是
A. 甲型流感病毒
B. 副流感病毒
C. 麻疹病毒
D. 腮腺炎病毒
E. 呼吸道合胞病毒

正确答案：A。甲型流感病毒

解析：呼吸道病毒主要分为正黏病毒科、副黏病毒科、披膜病毒科、小RNA病毒科、冠状病毒科。正黏病毒科主要为流感病毒，易于发生抗原性变异、温度敏感性变异，抗原性变异是其变异的主要形式；流感病毒甲、乙、丙三型，其中甲型流感病毒（A对）抗原性易发生变异。副黏病毒科包括副流感病毒（B错）、麻疹病毒（C错）、腮腺炎病毒（D错）、呼吸道合胞病毒（E错）等，与正黏病毒相比，副黏病毒抗原变异发生频率低。